属于抗菌素类牙膏成分的是
A. 洗必泰
B. 单氟磷酸钠
C. 氯化钾
D. 三氯羟苯醚
E. 氧化剂

正确答案：A。洗必泰

解析：洗必泰抗菌斑的作用机制是：①减少唾液中能吸附到牙面上的细菌数：洗必泰吸附到细菌表面，与细菌细胞壁的阴离子作用，增加了细胞壁的通透性，从而使洗必泰容易进入细胞内，使细胞质沉淀而杀灭细菌，因此吸附到牙面上的细菌数减少；②洗必泰与唾液酸性糖蛋白的酸性基团结合，从而封闭唾液糖蛋白的酸性基团，使唾液糖蛋白对牙面的吸附能力减弱，抑制获得性膜和菌斑的形成；③洗必泰与牙面釉质结合，覆盖了牙面，因而阻碍了唾液细菌对牙面的吸附；④洗必泰与Ca2＋竞争，而取代Ca2＋与唾液中凝集细菌的酸性凝集因子作用，并使之沉淀，从而改变了菌斑细菌的内聚力，抑制了细菌的聚积和对牙面的吸附。掌握“自我口腔保健方法”知识点。